伤食泄泻宜选用的方药是
A. 保和丸加减
B. 四神丸加减
C. 参苓白术散加减
D. 加味左金丸加减
E. 舒肝丸加减

正确答案：A。保和丸加减

解析：本题考查的是泄泻的辨证论治。伤食泄泻宜选用的方药是保和丸加减（A对）。泄泻食滞肠胃证：【症状】腹痛肠鸣，泻下粪便臭如败卵，泻后痛减，泻下伴有不消化食物，脘腹胀满，嗳腐吞酸，不思饮食。舌淡红，苔垢浊或厚腻，脉滑实。【方剂应用】基础方剂为保和丸（神曲、山楂、茯苓、半夏、莱菔子、陈皮、连翘、麦芽）加减。四神丸加减（B错）为泄泻肾阳虚衰证的方剂应用。泄泻肾阳虚衰证：【症状】黎明前脐腹作痛，肠鸣即泻，泻后则安，完谷不化，腹部喜暖，形寒肢冷，腰膝酸软。舌淡苔白，脉沉细。【方剂应用】基础方剂为四神丸（补骨脂、五味子、肉豆蔻、吴茱萸）加减。参苓白术散加减（C错）泄泻脾胃虚弱证的方剂应用。泄泻脾胃虚弱证：【症状】大便时溏时泻，迁延反复，食少，食后脘闷不舒，稍进油腻食物，则大便次数增多，面色萎黄，神疲倦怠。舌质淡，苔白，脉细弱。【方剂应用】基础方剂为参苓白术散（莲子肉、薏苡仁、砂仁、桔梗、白扁豆、白茯苓、人参、甘草、白术、山药）加减。方剂应用为加味左金丸加减（D错）或舒肝丸加减（E错）的病证，2022年考试指南未明确说明。